发育期的上颌正中间隙，在哪个牙萌出后间隙关闭
A. 上颌中切牙
B. 上颌尖牙
C. 下颌尖牙
D. 上颌第一双尖牙
E. 上颌第二双尖牙

正确答案：B。上颌尖牙

解析：本题考查混合牙列时期-上颌中切牙间隙。在替牙期间，由于颌弓暂时增长不足，上颌中切牙、侧切牙的牙根分别受到未萌出的侧切牙、尖牙牙冠向近中的挤压力，使上颌中切牙、侧切牙的牙冠向远中偏斜，继而两中切牙之间出现间隙；待侧切牙、尖牙（B对）相继萌出，同时牙槽骨又有所增长之后，切牙的牙体长轴可恢复正常，使上颌正中间隙关闭。